在企业健康促进活动中，其综合干预措施不包括
A. 从企业管理政策方面进行干预
B. 改善劳动环境
C. 完善职业卫生服务
D. 完善医疗保障制度
E. 针对职业危害因素进行卫生防护知识的教育

正确答案：E。针对职业危害因素进行卫生防护知识的教育